属于固有免疫应答的细胞是
A. T淋巴细胞
B. B淋巴细胞
C. NK细胞
D. 脂肪细胞
E. 上皮细胞

正确答案：C。NK细胞